男性患者，专业唢呐演员，自述左侧腮腺反复肿痛。检查时发现压迫左侧腮腺区，有浓稠液体自腮腺导管口流出，患者自述有咸味。其造影表现为主导管呈腊肠状，末梢导管呈点状扩张，则此病的病理表现可为
A. 小叶内导管上皮萎缩和纤维间质内中性粒浸润
B. 导管扩张，导管附近生成淋巴滤泡，小叶可见鳞状化生
C. 淋巴细胞、类上皮细胞和朗格汉斯细胞聚集，形成结节
D. 腺泡细胞坏死，导管上皮水肿
E. 腺体被膜充血，腺体纤维间质水肿

正确答案：B。导管扩张，导管附近生成淋巴滤泡，小叶可见鳞状化生

解析：根据此患者的检查指征和造影表现可判断为慢性化脓性唾液腺炎，其病理表现为唾液腺导管扩张，导管内有炎症细胞；导管周围及纤维间质中有淋巴细胞和浆细胞浸润，或形成淋巴滤泡；腺泡萎缩、消失而为增生的纤维结缔组织取代；小叶内导管上皮增生，并可见鳞状化生。掌握“慢性唾液腺炎的病理变化”知识点。